我国规定凡被确诊为法定职业病首先应做如何处理
A. 24小时之内
B. 立即住院治疗
C. 应立即向有关主管部门报告
D. 每6～12个月
E. 15天之内

正确答案：C。应立即向有关主管部门报告